指出下列牙齿演化的论述中哪一个是错误的
A. 牙数从少到多
B. 牙根从无到有
C. 从多列牙到双列牙
D. 从同形牙到异形牙
E. 从分散到集中

正确答案：A。牙数从少到多

解析：牙演化的特点：①牙形由单一同形牙向复杂异形牙演化；②牙数目由多变少；③牙的替换次数由多牙列向双牙列演化；④牙的分布由广泛至逐渐集中于上、下颌骨；⑤牙根从无到有，牙附着于颌骨的方式由端生牙至侧生牙，最后向槽生牙演化。掌握“牙的演化”知识点。